我国原卫生部发布的《文化娱乐场所卫生标准》适用于以下场所，除了
A. 茶座和咖啡厅
B. 影剧院
C. 录像厅（室）
D. 图书馆
E. 音乐厅

正确答案：D。图书馆

解析：本题考查我国原卫生部发布的《文化娱乐场所卫生标准》适用于的场所。我国原卫生部发布的《文化娱乐场所卫生标准》（GB 9664-1996）适用于影剧院（B对）、音乐厅（E对）、录像厅（室）（C对）、游艺厅、舞厅、酒吧、茶座和咖啡厅（A对），除了图书馆（D错，为本题正确答案）。